患者，男性，19岁，无业青年，父亲是生意人，该青年5年来一直在购买收藏女性的高跟鞋而感到满足，而且晚上要抱着高跟鞋睡觉，在心理咨询门诊诊断为“恋物癖”，对此类患者的治疗方法最好选择
A. 人本主义
B. 厌恶治疗
C. 自由联想
D. 系统脱敏
E. 梦的分析

正确答案：B。厌恶治疗